一小儿体重7Kg，身高65cm，头围42cm，乳牙2枚，能独坐一会，不能听懂自己的名字，此小儿的年龄最可能是
A. 9个月
B. 8个月
C. 7个月
D. 6个月
E. 5个月

正确答案：D。6个月

解析：请注意：在体格生长常用指标中，以头围判断年龄较准确，尤其2岁以内的小儿。正常足月儿出生时头围约33～34cm，3个月约为39～40cm，6个月约为42～43cm，1岁时约为46cm，2岁时约为48cm，5岁时约为50cm。本例头围42cm说明该小儿年龄约为6个月。6个月小儿能独坐一会，能用手摇玩具。根据“图2～5”（P14）得知，正常小儿6个月出牙，乳牙2枚。根据题干所给信息，整体来看，更倾向于6个月（D对），即使正常儿童一般6月龄时能听懂自己的名字（P16）。